在下列各项中，不属于病人道德权利的是
A. 病人拒绝试验性治疗
B. 女病人拒绝男医生进行妇科检查
C. 需要住院的非危重病人却拒绝住院
D. 传染病人拒绝医生上报疫情
E. 病人要求知悉自己的不良预后

正确答案：D。传染病人拒绝医生上报疫情